五行学说认为病情较重的色脉关系是
A. 色与脉的五行属性相同
B. 色与脉的五行属性相生
C. 客色胜主色
D. 色与脉的五行属性相克
E. 以上均非

正确答案：D。色与脉的五行属性相克

解析：《难经·十三难》：“经言见其色而不得其脉，反得相胜之脉者，即死。”色与脉的五行属性相克，例如面色赤（火）而得沉脉（水）之类。说明病情笃重，预后不佳（D对E错）。色与脉的五行属性相同属于常见的现象，无较轻较重之说（A错）。《难经·十三难》：“得具相生之脉，则病已矣。”色与脉的五行属性相生是病情较轻的（B错）。“主色”是指五脏的本色，“客色”是指应时之色。“客色”胜“主色”，其病为顺。例如夏季客色为赤，其人面白，客色胜主色，肺气虚，逢阳热相助易愈，故其病为顺（C错）。